关于肾实质的描述，错误的是
A. 分为肾皮质和肾髓质两部分
B. 皮质位于浅层，由肾小体和肾小管构成
C. 髓质位于深部，由15～20个肾锥体组成
D. 肾锥体的尖朝向皮质，称为肾乳头
E. 皮质伸入肾锥体之间的称为肾柱

正确答案：D。肾锥体的尖朝向皮质，称为肾乳头

解析：肾实质分为浅层的皮质和深层髓质（A对），皮质由肾小体和肾小管构成（B对），伸入肾锥体之间的肾皮质称肾柱（E对）；髓质由个底朝皮质，尖向肾窦（D错，为本题正确答案）的肾锥体组成（C对），2 ~3 个肾锥体尖端合并成肾乳头